患者，女，40岁。行经时小腹冷痛，拒按，喜暖，月经量少，色紫暗有块，伴四肢不温，面色青白，舌暗苔白，脉沉紧。其治疗除主穴外还应选用
A. 地机、太冲
B. 太冲、血海
C. 关元、肾俞
D. 关元、归来
E. 归来、血海

正确答案：D。关元、归来

解析：根据患者“行经时小腹冷痛，拒按，喜暖”的症状，可辨病为痛经实证，“四肢不温，面色青白”提示寒邪凝滞，“月经量少，色紫暗有块”提示血瘀，又根据“舌暗苔白，脉沉紧”的舌脉表现，可辨证为寒凝血瘀证，除治疗主穴外还应选用关元和归来（D对）。